大柴胡汤中配伍大黄的主要意义是
A. 内泻热结
B. 活血祛瘀
C. 和解清热
D. 泻火除湿
E. 缓急止痛

正确答案：A。内泻热结

解析：本题考查大柴胡汤的方解，属于理解记忆内容。大柴胡汤中轻用大黄配枳实以内泻阳明热结，行气消痞（A对）。大黄本身就有泄热通便的功效，大黄和枳实配伍是大承气汤，治疗阳明热结证。